社会调查资料的收集方法不包括
A. 文献法
B. 双盲法
C. 访谈法
D. 信访法
E. 观察法

正确答案：B。双盲法

解析：本题考查社会调查资料的收集方法。社会调查资料的收集方法包括文献法（A对）、访谈法（C对）、信访法（D对）、观察法（E对）等。双盲法（B错，为本题正确答案）是一种实验研究方法。